后腭杆位于
A. 上颌硬区之前
B. 上颌硬区
C. 上颌硬区之后，颤动线之前
D. 颤动线
E. 颤动线之后

正确答案：C。上颌硬区之后，颤动线之前

解析：本题考查后腭杆。后腭杆位于上颌硬区（又叫腭隆突或上颌隆突）之后，颤动线之前（C对）。前腭杆位于上颌硬区之前（A错）。上颌硬区（B错）黏膜覆盖薄，义齿容易以此为支点翘动和压痛，应避开。位于颤动线（D错）处会产生黏膜压痛。位于颤动线之后（E错），黏膜活动度大且容易恶心。